正确描述喉的有
A. 位于颈前部，平对第4－6颈椎
B. 是呼吸的管道，又是发音的器官
C. 借喉口向后通咽之喉部，向下通气管
D. 其神经支配主要来自迷走神经和交感神经
E. 以上全对

正确答案：E。以上全对

解析：成年人喉位于第3-6颈椎前方（A对）。喉是呼吸的管道，又是发音的器官（B对）。喉借喉口向后通咽之喉部，向下通气管（C对）。喉的神经支配主要来自迷走神经和交感神经（D对，故E为本题正确答案）。